小儿腹泻宁糖浆中含有的山梨酸是用作
A. 增溶剂
B. 润湿剂
C. 抑菌剂
D. 助悬剂
E. 助溶剂

正确答案：C。抑菌剂

解析：本题考查的是糖浆剂的附加剂。小儿腹泻宁糖浆中含有的山梨酸是用作抑菌剂（C对）。糖浆剂根据需要可加入适宜的附加剂，如需加入抑菌剂，除另有规定外，在制剂确定处方时，该处方的抑菌效力应符合《中国药典》抑菌效力检查法的规定，山梨酸和苯甲酸的用量不得过0.3%（其钾盐、钠盐的用量分别按酸计），羟苯酯的用量不得过0.05%。如需加入其他附加剂，其品种与用量应符合国家标准的有关规定，且不影响成品的稳定性，并应避免对检验产生干扰。必要时，可在糖浆剂中加入适量的乙醇、甘油或其他多元醇。糖浆剂应澄清，在贮存期间不得有发霉、酸败、产生气体或其他变质现象，允许有少量摇之易散的沉淀。应密封，避光置干燥处贮存。按照《中国药典》规定的方法检查，糖浆剂的pH、相对密度、装量及微生物限度等均应符合规定。增溶剂（A错）、助悬剂（D错）与助溶剂（E错）为注射剂的添加剂。配制注射制剂时，可根据需要加入适宜的附加剂，如渗透压调节剂、pH调节剂、增溶剂、助溶剂、抗氧剂、抑菌剂、乳化剂、助悬剂等。润湿剂（B错）与为混悬液的添加剂。混悬液的润湿剂：系指疏水性药物制备混悬剂时，常加入以利于分散的附加剂。常用的润湿剂有吐温类、司盘类表面活性剂等。